可产生独特的前庭反应的药物是
A. 氯霉素
B. 青霉素
C. 四环素
D. 米诺环素
E. 多西环素

正确答案：D。米诺环素

解析：米诺环素产生独特的前庭反应，出现恶心、呕吐、眩晕、运动失调等症状；首剂服药可迅速出现。掌握“四环素、多西环素及米诺环素”知识点。